患者，女，32岁。诊断为慢性宫颈炎症、柱状上皮外移，使用聚甲酚磺醛栓治疗。关于该药物使用注意事项的说法，错误的是
A. 治疗期间避免性交
B. 月经期间暂停治疗
C. 避免同时在局部合用其它药物
D. 有刺激性，注意避免接触到眼睛
E. 妊娠期可以安全使用

正确答案：E。妊娠期可以安全使用

解析：本题考查聚甲酚磺醛栓的使用。妊娠期间应避免使用聚甲酚磺醛栓（E错，为本题正确答案）。使用聚甲酚磺醛栓治疗时需注意：（1）本品只能局部用药，严禁内服。（2）阴道用药时，会发生大片白色坏死组织脱落，为治疗后正常现象。老年患者慎用。（3）治疗期间避免性交（A对）。（4）月经期间停止治疗（B对）。（5）妊娠期间不宜阴道局部用药。（6）治疗时避免在局部同时使用其它药物（C对）。（7）用阴道栓时，应放入阴道深部贴近宫颈处。（8）如为皮肤伤口，不宜用刺激性肥皂清洗。（9）本品有刺激性，注意避免接触到眼睛（D对）。（10）因本品为高酸性，所有织物沾上药后应立即用水洗净。治疗用具用完后应浸泡在水中。（11）阴道栓剂如出现斑点，是其基质产生的自然现象，不影响药物使用。（12）上药时，有的会发生轻度局部刺激症状，阴道烧灼感和肛门下坠感，一般不需处理，大多继续用药症状自行消失。